患者，女，27岁，已婚。人流术后恶露持续20天未净，量较多，色紫红，质稠，有臭味，面色潮红，口燥咽干，舌质红，脉细数。其证候是
A. 气虚
B. 血虚
C. 血热
D. 湿热
E. 阴虚

正确答案：C。血热

解析：题中患者人流术后恶露持续20天未净，故诊断为产后恶露不绝。人流术后失血伤津，阴液益亏，虚热内生，热扰冲任，迫血下行，故恶露持续20多天未净，量较多，色紫红，质粘稠而臭秽；虚火上炎，故面色潮红；阴液不足，津不上呈，故口燥咽干；舌质红，脉细数均为血热内扰之象，故辨为血热证。气虚证多量多、色淡红、质稀、无臭气（A错）。产后恶露不绝无血虚的证候（B错）。题中诊断为产后恶露不绝血热证（C对）。产后恶露不绝无湿热证（D错）。产后恶露不绝无阴虚证（E错）。